清肝明目，消肿散结的药是
A. 夏枯草
B. 密蒙花
C. 谷精草
D. 青葙子
E. 决明子

正确答案：A。夏枯草

解析：本题考查的是夏枯草的功效。清肝明目，消肿散结的药是夏枯草（A对）。夏枯草：【功效】清肝明目，散结消肿。密蒙花（B错）：【功效】清热养肝，明目退翳。谷精草（C错）：【功效】疏散风热，明目退翳。青葙子（D错）：【功效】清肝泻火，明目退翳。决明子（E错）：【功效】清肝明目，润肠通便。